初产妇，29岁。胎儿娩出30分钟后出现阴道流血200ml，用手在产妇耻骨联合上方轻压子宫下段时，外露的脐带回缩。此时正确的处理措施是
A. 立即输血
B. 按压宫底，牵拉脐带
C. 等待胎盘剥离
D. 徒手剥离胎盘
E. 子宫体注射麦角新碱

正确答案：D。徒手剥离胎盘

解析：青年初产妇，胎儿娩出30分钟后出现阴道流血200ml，用手在产妇耻骨联合上方轻压子宫下段时，外露的脐带回缩，为胎盘未剥离的征象。阴道大量出血，应考虑胎盘因素（粘连、植入或嵌顿等），若胎盘粘连，可先试行徒手剥离胎盘（D对C错），若剥离困难，应怀疑胎盘植入，此时立即停止剥离，根据患者出血情况及胎盘剥离面积，行保守治疗或子宫切除术。接产者切忌在胎盘尚未完全剥离之前，用手按揉、下压宫底或牵拉脐带（第2版实用妇产科学P132）（B错），以免引起胎盘部分剥离而出血或拉断脐带，甚至造成子宫内翻。胎盘娩出后，可经子宫体注射麦角新碱（P184）（E错），促进子宫收缩，预防产后出血。立即输血（A错）主要用于失血性休克，该产妇阴道流血200ml，不会引发休克。